右心衰竭时不大可能出现下列哪种变化
A. 水肿
B. 肝颈静脉返流征（＋）
C. 少尿
D. 两肺湿性罗音，咳粉红色泡沫痰
E. 食欲不振，消化吸收不良

正确答案：D。两肺湿性罗音，咳粉红色泡沫痰

解析：右心衰竭时，右心输出量降低，右心室舒张期充盈压增高，体循环血液回流受阻引起淤血，表现为静脉过度充盈、内脏淤血、水肿。右心输出量降低，肾血流灌注减少，出现少尿（C错）。右心衰时的水肿（A错）为心性水肿，在体位低的下肢表现最为明显。右心衰体循环淤血明显时出现颈静脉充盈或怒张，按压肝脏后颈静脉异常充盈，称为肝颈静脉反流征（+）（B错）。右心衰时的胃肠淤血可导致消化系统功能障碍，出现食欲不振，消化吸收不良（E错）。两肺湿性罗音，咳粉红色泡沫痰（D对）为急性左心衰的临床表现，是因肺淤血急性加重，肺泡毛细血管壁通透性增大，血浆渗出到肺泡所致。